男性，30岁，因3天来左上后牙肿痛来就诊。查26咬合面龋深及髓，无探痛，Ⅲ度松动，叩痛（+++），龈轻红肿，有扪痛，无波动感。诊断应为
A. 急性根尖周脓肿
B. 急性蜂窝织炎
C. 急性牙龈乳头炎
D. 急性颌骨骨髓炎
E. 急性化脓性牙髓炎

正确答案：A。急性根尖周脓肿

解析：急性根尖周炎各期的临床表现。掌握“急性根尖周炎”知识点。